国家基本药物使用管理中提出的基本药物优先选择和合理使用制度是指
A. 公立医院对基本药物实行“零差率”销售
B. 政府举办的医疗卫生机构全部配备和优先使用基本药物
C. 政府举办的基层医疗卫生机构全部配备和使用基本药物，其他医疗机构按照规定使用基本药物
D. 所有零售药店均配备基本药物，并对基本药物实行“零差率”销售

正确答案：C。政府举办的基层医疗卫生机构全部配备和使用基本药物，其他医疗机构按照规定使用基本药物

解析：本题考查国家基本药物使用管理。国家基本药物使用管理中提出的基本药物优先选择和合理使用制度是指政府举办的基层医疗卫生机构全部配备和使用基本药物，其他医疗机构按照规定使用基本药物（C对）。《国家基本药物目录管理办法》第一条：基本药物是适应基本医疗卫生需求，剂型适宜，价格合理，能够保障供应，公众可公平获得的药品。政府举办的基层医疗卫生机构全部配备和使用基本药物，其他各类医疗机构也都必须按规定使用基本药物（B错）。